属于必需脂肪酸的是
A. 亚油酸、亚麻酸、花生四烯酸
B. 油酸、亚麻酸、花生四烯酸
C. 亚油酸、软脂酸、花生四烯酸
D. 亚麻酸、硬脂酸、亚油酸
E. 亚麻酸、亚油酸、软脂酸

正确答案：A。亚油酸、亚麻酸、花生四烯酸

解析：属于必须脂肪酸的是亚油酸、ɑ-亚麻酸、花生四烯酸（A对）。油酸、软脂酸和硬脂酸等属于非必需脂肪酸（BCDE错）。